治疗肩臂痛，臂不能举，应首选
A. 外关
B. 合谷
C. 曲池
D. 肩前
E. 阳陵泉

正确答案：D。肩前

解析：肩前穴乃经外奇穴，定位在肩部，正坐垂臂，当腋前皱襞顶端与肩髃穴连线的中点，可治疗肩臂痛，臂不能举（D对）。外关主治：①热病；②头痛、目赤肿痛、耳鸣、耳聋等头面五官病证；③凛窈；④胁肋痛；⑤上肢痿痹不遂（A错）。合谷主治：①头痛、目赤肿痛、齿痛、耳聋等头面五官诸疾；②发热恶寒等外感病证，热病无汗或多汗；③经闭、滞产等妇产科病证（B错）。曲池同样可治疗手臂痹痛、上肢不遂等上肢病证，但对于肩臂痛，臂不能举的病证并不是首选（C错）。阳陵泉主治：膝腘肿痛、挛急及小腿麻木等下肢、膝关节疾患（E错）。